对稳定蛋白质构象通常不起作用的是
A. 氢键
B. 范德华力
C. 疏水键
D. 盐键
E. 酯键

正确答案：E。酯键

解析：本题考查蛋白质三级结构。酯键（E错，为本题的正确答案）常见于酸和碱脱水缩合反应后形成，主要存在于酯类物质，不存在于蛋白质中。维持蛋白质三级结构的稳定主要靠次级键如疏水键（C对）、盐键（D对）、氢键（A对）和范德华力（B对）等。